医疗机构临床用血文书不包括
A. 输血治疗知情同意书
B. 输血过程和输血后疗效评价意见
C. 输血记录单
D. 患者输血适应证的评估
E. 献血员信息

正确答案：E。献血员信息

解析：《医疗机构临床用血管理办法》第二十八条医疗机构应当建立临床用血医学文书管理制度，确保临床用血信息客观真实、完整、可追溯。医师应当将患者输血适应证的评估、输血过程和输血后疗效评价情况记入病历；临床输血治疗知情同意书、输血记录单等随病历保存。掌握“医疗机构临床用血管理、及法律责任”知识点。